女，45岁，厨师，头痛半年，加重伴呕吐1个月。无高血压，心脏病病史。查体：BP130/86mmHg，颈无抵抗，眼底检查发现视乳头水肿，头颅CT检查提示脑实质多个低密度病灶，最可能的诊断是
A. 脑肿瘤
B. 嚢尾蚴病
C. 腔隙性脑梗死
D. 脑出血
E. 脑脓肿

正确答案：B。嚢尾蚴病

解析：中年女性患者，厨师（职业因素），头痛半年，加重伴呕吐一个月，眼底检查发现视神经乳头水肿（颅内压增高的 “三主征”），查体：BP130/86mmHg，颈无抵抗（脑膜刺激征（-），排除颅内感染），头颅CT检查提示脑实质多个低密度灶，综合患者的职业、症状、体征、辅助检查，该患者的诊断考虑为脑囊尾蚴病。脑囊尾蚴病，由猪带绦虫的幼虫囊尾蚴寄生于人脑所致，严重感染者可出现颅内压增高的症状，CT表现为脑内多个低密度灶（B对）；脑转移瘤CT也可表现为多发的低密度灶，但癌周脑白质一般水肿严重（A错）；腔隙性脑梗死多见于中老年患者，多有高血压病史，通常症状较轻，体征单一，一般无头痛、颅高压和意识障碍等表现（C错）；脑出血的典型CT表现为，圆形或卵圆形的均匀高密度灶，边界清楚（D错）；健康脑组织对细菌有一定抵御能力，因此脑脓肿大多继发于颅外感染，多数病人有近期感染或慢性中耳炎急性发作史（E错）。